精神药品进口、出口准许证的颁发部门是
A. 国务院药品监督管理部门
B. 省级药品监督管理部门
C. 县以上药品监督管理部门
D. 县以上卫生行政部门
E. 经营、使用单位

正确答案：A。国务院药品监督管理部门